刺激机体产生类风湿因子的抗原是
A. 变性IgA
B. 变性IgD
C. 变性IgE
D. 变性LgG
E. 变性IgM

正确答案：D。变性LgG